患者，女性，22岁，4天前因劳累出现左侧下后牙龈胀痛，进食吞咽时加重，昨日起出现局部自发性跳痛，面部肿胀，张口受限，伴发热。检查：左侧颊部肿胀，局部皮温增高，压痛明显，局限于咬肌前缘处，并及凹陷性水肿；张口度约二指，左下颌第三磨牙近中低位阻生，牙龈瓣覆盖其上，充血肿胀，并见糜烂，挤压局部少量脓液溢出，同侧第一磨牙前庭沟丰满充血，压痛存在，第一磨牙叩诊（-），无松动，无龋坏，未及牙周袋。该患者最有可能的诊断是左侧第三磨牙冠周炎。该患者第一磨牙颊侧前庭沟处肿胀原因为
A. 根尖脓肿
B. 牙周脓肿
C. 根尖囊肿继发感染
D. 第三磨牙冠周脓肿扩散引起
E. 颊间隙感染引起

正确答案：D。第三磨牙冠周脓肿扩散引起

解析：本题考查第一磨牙颊侧前庭沟处肿胀的原因。智齿冠周炎脓肿扩散（D对）时可沿下颌骨外斜线向前，可在相当于下颌第一磨牙颊侧黏膜转折处的骨膜下形成脓肿、破溃成瘘，引起第一磨牙颊侧前庭沟处肿胀。急性根尖脓肿（A错）临床表现为①自发性剧烈跳痛，伸长感加重，咬合痛，②叩痛明显且牙齿松动，根尖部牙龈潮红无明显肿胀，扪诊轻微疼痛，③下颌下淋巴结或颏下淋巴结肿大、压痛。牙周脓肿（B错）是牙周炎晚期常见伴发症状，急性牙周脓肿早期炎症水肿，患牙唇颊侧或舌腭侧牙龈形成椭圆形或半球状的肿胀突起，有搏动性疼痛，患牙“浮起感”，叩痛，松动明显；后期扪诊有波动感，脓肿可自行破溃，疼痛减轻。根尖周囊肿（C错）即根端囊肿，多发生于前牙，初期无自觉症状，膨胀生长可形成面部畸形，扪诊乒乓球样感，发出羊皮纸样脆裂声，最后骨板吸收可有波动感。可在口内发现深龋、残根或死髓牙。破裂可见草黄（绿）色囊液，如有继发感染，则出现炎症，患者感觉胀痛、发热、全身不适。颊间隙感染（E错）主要引起颊部皮肤及颊黏膜下脓肿，病变局限，可形成多间隙感染。